牙周基础治疗的内容不包括
A. 控制菌斑
B. 药物治疗
C. 拔除无保留价值的患牙
D. 调（牙合）
E. 永久性松牙固定术

正确答案：E。永久性松牙固定术

解析：本题考查牙周基础治疗的内容。牙周基础治疗的内容不包括永久性松牙固定术（E错，为本题的正确答案）。牙周病的治疗过程一般分为四个阶段，基础治疗、牙周手术治疗、修复治疗、牙周支持治疗。控制菌斑（A对）、药物治疗（B对）、拔除无保留价值的患牙（C对）、调（牙合）（D对）属基础治疗，当牙龈的外形和龈缘位置基本稳定，可进行永久性固定修复，永久性松牙固定术属修复治疗，非基础治疗。